以适当的浓度应用于局部神经末梢周围，能暂时、完全和可逆性地阻断神经冲动的产生和传导，在意识清醒的条件下可使局部痛觉等感觉暂时消失的药物称为
A. 局部麻醉剂
B. 局部封闭剂
C. β受体阻滞剂
D. β受体激动剂
E. 强心剂

正确答案：A。局部麻醉剂

解析：局部麻醉药简称局麻药，是一类以适当的浓度应用于局部神经末梢或神经干周围的药物。本类药物能暂时、完全和可逆性地阻断神经冲动的产生和传导，在意识清醒的条件下可使局部痛觉等感觉暂时消失，局麻作用消失后，神经功能可完全恢复，同时对各类组织无损伤性影响。掌握“局麻药”知识点。